下列物质可以作为合成DNA原料的是
A. dAMP，dGMP，dCMP，dTMP
B. dATP，dGTP，dCTP，dTTP
C. dADP，dGDP，dCDP，dTDP
D. dATP，dGTP，dCTP，dUTP
E. dAMP，dGMP，dCMP，dUMP

正确答案：B。dATP，dGTP，dCTP，dTTP